下列中药中呈长圆柱形，节上有膜质鳞叶的药材是
A. 车前草
B. 益母草
C. 淡竹叶
D. 麻黄
E. 槲寄生

正确答案：D。麻黄

解析：本题考查的是麻黄药材的性状鉴别。下列中药中呈长圆柱形，节上有膜质鳞叶的药材是麻黄（D对）。麻黄：【性状鉴别】药材草麻黄呈细长圆柱形，少分枝。有的带少量棕色木质茎。表面淡绿色至黄绿色，有细纵脊线，触之微有粗糙感。节明显。节上有膜质鳞叶；裂片锐三角形，先端灰白色，反曲，基部联合成筒状，红棕色。体轻，质脆，易折断，断面略呈纤维性，周边绿黄色，髓部红棕色，近圆形。气微香，味涩、微苦。车前草（A错）：【性状鉴别】药材车前根丛生，须状。叶基生，具长柄；叶片皱缩，展平后呈卵状椭圆形或宽卵形；表面灰绿色或污绿色，具明显弧形脉；先端钝或短尖，基部宽楔形，全缘或有不规则波状浅齿。穗状花序数条，花茎长。蒴果盖裂，萼宿存。气微香，味微苦。益母草（B错）：【性状鉴别】药材干益母草茎方柱形，上部多分枝，四面凹下成纵沟；表面灰绿色或黄绿色；体轻，质韧，断面中部有白色髓。叶形多种，茎中部叶交互对生，有柄；叶片灰绿色，多皱缩和破碎，易脱落；完整者下部叶掌状3裂，上部叶羽状深裂或3浅裂，最上部的叶不分裂，线形，近无柄。轮伞花序腋生，小花淡紫色，花萼筒状，花冠二唇形。气微，味微苦。切段者长约2cm。淡竹叶（C错）：【性状鉴别】药材茎呈圆柱形，有节，表面淡黄绿色，断面中空。叶鞘开裂。叶片披针形，有的皱缩卷曲；表面浅绿色或黄绿色。叶脉平行，具横行小脉，形成长方形的网格状，下表面尤为明显。体轻，质柔韧。气微，味淡。槲寄生（E错）：【性状鉴别】药材茎枝呈圆柱形，2～5叉状分枝；表面黄绿色、金黄色或黄棕色，有纵皱纹；节膨大，节上有分枝或枝痕。体轻，质脆，易折断，断面不平坦，皮部黄色，木部色较浅，射线放射状，髓部常偏向一边。叶对生于枝梢，易脱落，无柄；叶片呈长椭圆状披针形；先端钝圆，基部楔形，全缘；表面黄绿色，有细皱纹，主脉5出，中间3条明显；革质。气微，味微苦，嚼之有黏性。